女，65岁。腹胀伴食欲不振半年余。查体：腹部膨隆，移动性浊音（+）。妇科检查：宫颈光滑，盆底可触及多个质硬结节。左侧附件区可触及包块，约6cm×5cm大小，呈囊实性，界限不清。下列对该患者鉴别诊断价值最小的辅助检查是
A. 宫腔镜检查
B. 腹水查癌细胞
C. 消化道内镜检查
D. 血肿瘤标志物检测
E. B超检查

正确答案：C。消化道内镜检查

解析：该患者为老年女性，腹胀伴食欲不振半年余（卵巢恶性肿瘤早期常无症状，晚期主要症状为腹胀、腹部肿块、腹腔积液及其他消化道症状），腹部膨隆，移动性浊音（+）（常伴腹腔积液）。妇检：宫颈光滑，盆底可触及多个质硬结节。左侧附件区可触及包块，约6cm×5cm大小，呈囊实性，界限不清（三合诊检查可在直肠子宫陷凹处触及质硬结节或肿块，肿块多为双侧，实性或囊实性，表面凹凸不平，活动差，与子宫分界不清），怀疑为卵巢恶性肿瘤。为鉴别诊断可行以下措施：宫腔镜检查（A错）可观察到宫腔内情况，看是否有转移。腹水查癌细胞（B错）可确定卵巢肿瘤的性质。B超检查（E错）了解肿块的部位、大小、形态，囊性或实性，囊内有无乳头。肿瘤标志物检测（D错）可鉴别肿瘤类别，如血清CA125是诊断卵巢癌价值最大的肿瘤标志物。消化道内镜（C对）主要用于观察胃肠道病变，且库肯勃瘤常见于卵巢双侧肿瘤，故诊断意义不大。